男婴，3个月。口内出现白膜1周，伴低热。检查上下唇内侧，双颊黏膜广泛充血，可见凝乳状的白色斑片，用力可擦去。确诊应该进行的检查是
A. 血常规检查
B. 尿常规检查
C. 涂片检查
D. 病理检查
E. 血清学检查

正确答案：C。涂片检查

解析：新生儿鹅口疮多在出生后2～8日内发生，好发部位为颊、舌、软腭及唇。损害区黏膜充血，有散在的色白如雪的柔软小斑点，如帽针头大小，不久即相互融合为白色或蓝白色丝绒状斑片，并可继续扩大蔓延至扁桃体、咽部、牙龈。早期黏膜充血较明显，故呈鲜红色与雪白的对比。而陈旧的病损黏膜充血减退，白色斑片带淡黄色。斑片附着不十分紧密，稍用力可擦掉，暴露红的黏膜糜烂面及轻度出血。取口腔黏膜区假膜、脱落上皮等标本，涂一薄层于载玻片上，滴入10%KOH溶液，微加热以溶解角质后在显微镜下直接观察，可见折光性强的芽生孢子和假菌丝，如查到大量的假菌丝，说明念珠菌处于致病状态；该方法对于确定念珠菌致病性有意义。掌握“口腔念珠菌病”知识点。